具有健脾补肾，益气摄血功用的方剂是
A. 固冲汤
B. 归脾汤
C. 四物汤
D. 黄土汤
E. 固经汤

正确答案：A。固冲汤

解析：健脾补肾，益气摄血，即主治脾肾气虚，冲脉失固而出血。固冲汤中重用山萸肉， 甘酸而温，既能补益肝肾，又能收敛固涩，为君药；白术（臣）补气健脾；黄芪（臣）益气兼升举；龙骨、牡蛎煅用，共助君药固涩滑脱止血，棕榈炭、五倍子味涩收敛，善收敛止血， 海螵蛸、茜草固摄下焦，既能止血，又能化瘀，使血止而无留瘀之弊。共奏健脾补肾，益气摄血之功（A对）。归脾汤功用为益气补血，健脾养心（B错）。四物汤功用为补血和血（C错）。黄土汤功用为温阳健脾，养血止血（D错）。固经汤功用为滋阴清热，固经止血（E错）。